用温热药治疗寒证称
A. 阴中求阳
B. 阳中求阴
C. 寒者热之
D. 扶阳抑阴
E. 补阴抑阳

正确答案：C。寒者热之

解析：本题考查的是寒者热之治法。用温热药治疗寒证称寒者热之（C对）。寒者热之：寒者热之又称“以热治寒”，是指寒性病证出现寒象，用温热方药进行治疗。如表寒证用辛温解表方药，里寒证用辛热温里方药等。阴中求阳（A错）：在补阳时可适当配用补阴药的治法，使阳得阴助而生化无穷。阳中求阴（B错）：在补阴时可适当配用补阳药的治法，使阴得阳生而泉源不竭。扶阳抑阴（D错）即阴病治阳。阴病治阳：针对阳虚而阳不制阴，阴气偏亢的虚寒证，应采用助阳以抑阴的治法，又称为“益火之源，以消阴翳”。补阴抑阳（E错）即阳病治阴。阳病治阴：针对阴虚而阴不制阳，阳气偏亢的虚热证，应采用滋阴以制阳的治法，又称为“壮水之主，以制阳光”。